新斯的明最强的作用是
A. 兴奋胃肠道平滑肌
B. 兴奋膀胱平滑肌
C. 缩小瞳孔
D. 兴奋骨骼肌
E. 增加腺体分泌

正确答案：D。兴奋骨骼肌

解析：新斯的明又称为间接作用拟胆碱药，难以透过血脑屏障，基本无中枢作用，对心血管、腺体、眼和支气管平滑肌作用较弱，对胃肠道和膀胱等平滑肌作用较强，而对骨骼肌作用最强。掌握“易逆性抗胆碱酯酶药”知识点。